非水溶液滴定法使用的滴定液是
A. 氢氧化钠滴定液
B. 甲醇钠滴定液
C. 碘滴定液
D. 硝酸银滴定液
E. 乙二胺四醋酸二钠滴定液

正确答案：B。甲醇钠滴定液

解析：本题考查非水溶液滴定法。非水溶液滴定法使用的滴定液是甲醇钠（B对）。非水溶液滴定法包括非水碱量法和非水酸量法。非水碱量法溶剂为冰醋酸或冰醋酸-醋酐，滴定液为高氯酸的冰醋酸溶液；非水酸量法溶剂为乙二胺或二甲基甲酰胺，滴定液为甲醇钠。氢氧化钠（A错）为酸碱滴定法使用的滴定液。碘滴定液（C错）是直接碘量法使用的滴定液。硝酸银滴定液（D错）是沉淀滴定法使用的滴定液。乙二胺四醋酸二钠滴定液（E错）是配位滴定法使用的滴定液。